HLAⅠ类抗原不在下列哪一细胞表面表达
A. 淋巴细胞
B. 成熟红细胞
C. 巨噬细胞
D. 网织红细胞
E. 粒细胞

正确答案：B。成熟红细胞